慢性根尖周炎中最多见的病变类型，镜下表现以增生为主的炎症性反应，并有肉芽组织形成的类型是
A. 慢性根尖周肉芽肿
B. 急性牙槽脓肿
C. 急性牙周脓肿
D. 根尖周囊肿
E. 致密性骨炎

正确答案：A。慢性根尖周肉芽肿

解析：本题考查急慢性根尖周炎。慢性根尖周炎中最多见的是根尖周肉芽肿（A对）。它是根尖周牙周膜受根管内病原慢性刺激，表现为以增生为主的炎症反应，和肉芽组织的形成。